牙髓息肉为
A. 主要表现为慢性炎症性牙髓组织的过多增生
B. 表面都有上皮覆盖
C. 患牙一般无穿髓孔
D. 多见于老年人
E. 多发生于尖牙

正确答案：A。主要表现为慢性炎症性牙髓组织的过多增生

解析：在慢性增生性牙髓炎时，患牙有较大的穿髓孔，并且根尖孔粗大，牙髓血运丰富，使炎性牙髓组织增生呈息肉状；经穿髓孔突出，多见于儿童、青少年。常发生在乳磨牙或第一恒磨牙。掌握“可复性、急慢性牙髓炎”知识点。